中药合剂制备最常用的方法是
A. 水提醇沉法
B. 吸附澄清法
C. 大孔树脂吸附法
D. 超滤法
E. 反渗透法

正确答案：A。水提醇沉法